病人感到周围的环境和失去了色彩和生机，好像与自己隔了一层膜，该表现属于
A. 幻觉
B. 人格解体
C. 梦样状态
D. 朦胧状态
E. 非真实感

正确答案：E。非真实感

解析：该病人感到周围的环境和失去了色彩和生机，好像与自己隔了一层膜即为非真实感（E对）。幻觉是没有现实刺激作用于感觉器官时出现的知觉体验（A错），是一种虚幻的知觉。梦样状态表现为外表好像清醒，但患者完全沉湎于幻觉幻想中，就像做梦一样，与外界失去联系（C错）。蒙眬状态表现为患者在狭窄的意识范围内，可有相对正常的感知觉，以及协调连贯的复杂行为，但除此范围以外的事物却不能进行正确感知（D错）。